根据国情，我国学者提出心理健康的标准不包括
A. 智力正常
B. 情绪良好
C. 人际和谐
D. 人格完整
E. 性格良好

正确答案：E。性格良好